左斜角肌淋巴结
A. 其输出淋巴管形成锁骨下干
B. 收纳上肢淋巴
C. 直接收纳胃和食管下段淋巴
D. 位于左侧前斜角肌前方
E. 属腋淋巴结群

正确答案：D。位于左侧前斜角肌前方

解析：左斜角肌淋巴结属于颈外侧淋巴结（E错），输出管形成颈干（A错）。左斜角肌淋巴结位于左侧前斜角肌前方（D对）。